城市绿化是指
A. 在城市中栽种植物和利用自然条件以改善城市生态，保护环境，为居民提供游憩场地和美化城市景观的活动
B. 保护和恢复城市生物多样性
C. 建设结构优化、功能高效、布局合理的绿地系统
D. 以上都是
E. 以上都不是

正确答案：A。在城市中栽种植物和利用自然条件以改善城市生态，保护环境，为居民提供游憩场地和美化城市景观的活动

解析：本题考查城市绿化。城市绿化是在城市中栽种植物和利用自然条件以改善城市生态、保护环境、为居民提供游憩场地和美化城市景观的活动（A对BCDE错）。